氨茶碱与镇静催眠药合用，可减少
A. 神经系统毒性
B. 中枢兴奋作用
C. 降压作用
D. 低血钾
E. 骨髓抑制

正确答案：B。中枢兴奋作用